恒牙龋病的最好发部位是
A. 磨牙（牙合）面窝沟
B. 后牙邻面
C. 后牙颈部
D. 后牙颊面
E. 前牙邻面

正确答案：A。磨牙（牙合）面窝沟

解析：本题考查恒牙龋病的好发部位。恒牙龋病的最好发部位是磨牙（牙合）面窝沟（A对），这是因为窝沟易成为菌斑滞留的场所，且深的窝沟不易被清理到，食物残渣和微生物的滞留造成了龋的发生。相比之下后牙邻面（B错）、后牙颈部（C错）、后牙颊面（D错）、前牙邻面（E错）一般无深的窝沟，相对磨牙（牙合）面窝沟，龋病的发生率较低。